患者，女，48岁，因进食高蛋白食物过多导致消化不良、胃胀气到药店购药，药师应推荐的药品是
A. 多潘立酮片
B. 酵母片
C. 乳酶生片
D. 甲氧氯普胺片
E. 铝碳酸镁咀嚼片

正确答案：C。乳酶生片

解析：本题考查消化不良用药。乳酶生片（C对）、胃蛋白酶合剂可用于偶然性消化不良或进食蛋白质食物过多者。对餐后不适综合征可选用胃动力药，伴有恶心或呕吐者可选用甲氧氯普胺片（D错）和多潘立酮片（A错）。酵母片（B错）用于食欲减退者。铝碳酸镁咀嚼片（E错）可用于胃食管反流病患者胸痛偶发。